邻面的早期龋损可以用下列哪种方法帮助检查
A. 探诊
B. 牙线
C. 温度测试
D. 叩诊
E. 视诊

正确答案：B。牙线

解析：本题考查邻面的早期龋损的检查。邻面的早期龋损可以用牙线（B对）帮助检查。邻面早期龋损，探针难以进入，故不宜使用探诊检查（A错），可使用牙线进行检查，将牙线自咬合面滑向牙间隙，然后自颈部拉出，检查牙线，若牙线变毛或有撕脱的情况，则可能有龋病病变。温度测验一般用于牙髓活力的检测，早期龋损未累及牙髓，不会出现牙髓病变（C错）。叩诊多用于根尖周病变的检查（D错）。邻面早期龋损，颜色多为白垩色，视诊检查不易发现（E错）。